男性青年，34岁，由于吃辛辣食物致舌体疼痛十年，但是无其他不适，遂前来就诊。查可见：舌背中央一深沟回，镊子拨开深沟当中舌乳头见食物残渣，部分舌乳头有炎症，舌背除深沟以外的其他部分颜色正常，柔软，无硬结。右上颌5远中有邻面龋，左下456（牙合）面黄金嵌体修复，牙龈颜色正常，黏膜形态、颜色无异常。已诊断为沟纹舌，其正确的局部治疗方法为
A. 不用治疗，观察
B. 牙周常规超声波洁治
C. 口服甲硝唑
D. 消炎防腐止痛含漱剂漱口
E. 手术切除

正确答案：D。消炎防腐止痛含漱剂漱口

解析：沟纹舌无症状者不需治疗。但是有炎症时，局部治疗以抗感染为主。炎症时，用消炎防腐止痛含漱剂，软膏或散剂，如可用0.2%氯己定，2%碳酸氢钠等漱口。含漱时需将舌背拱起，以去除沟中食物，起到局部清洗和消炎作用。掌握“地图舌、沟纹舌及舌乳头炎”知识点。